患者外出着凉后，始见时时振寒，发热，继而壮热汗出，烦躁不宁，咳嗽气急，咳吐腥臭浊痰，胸满作痛，口干苦，便秘，舌红苔黄腻，脉滑数。治疗应首选：
A. 清金化痰汤
B. 苇茎汤合如金解毒散
C. 桑白皮汤
D. 竹叶石膏汤
E. 加味桔梗汤

正确答案：B。苇茎汤合如金解毒散

解析：患者咳吐腥臭浊痰，可以诊断为肺痈。患者咳嗽气急，咳吐腥臭浊痰，胸满作痛，伴振寒，发热，继而壮热汗出，烦躁不宁，口干苦，便秘，可辨其病程属于成痈期。邪热从表入里，热毒内盛，正邪交争，故出现壮热、振寒、汗出、烦躁的症状；热毒壅肺，肺气上逆，肺络不和，则咳嗽气急胸痛；痰浊瘀热郁蒸成痈，则咳吐腥臭浓痰；热入血分，伤津耗液，故口干；治宜清热解毒，化瘀消痈；代表方为苇茎汤合如金解毒散（B对）。清金化痰汤为咳嗽痰热郁肺证的代表方（A错）。桑白皮汤为喘证痰热郁肺证的代表方（C错）。竹叶石膏汤清热生津，益气和胃，主治伤寒、温病、暑病余热未清，气阴两伤证（D错）。加味桔梗汤为治疗肺痈溃脓期代表方（E错）。